单侧隐睾手术治疗应在
A. 2岁以前
B. 3～6岁
C. 7～10岁
D. 青春期
E. 婚后影响生育时

正确答案：A。2岁以前

解析：隐睾症是指睾丸下降异常，使睾丸不能降至阴囊而停留在腹膜后、腹股沟管或阴囊入口处。1岁内的睾丸有自行下降的可能，若1岁以后仍未下降，可短期应用绒毛膜促性腺激素。若2岁以前睾丸仍未下降，则需行单侧睾丸固定术（A对）将其拉下。